2型糖尿病患者血糖控制的目标是
A. HbAlc＜5.0%
B. HbAlc＜5.5%
C. HbAlc＜6.0%
D. HbAlc＜6.5%
E. HbAlc＜7.0%

正确答案：E。HbAlc＜7.0%